既能屈腕又能收腕的肌是
A. 肱桡肌
B. 掌长肌
C. 拇长屈肌
D. 尺侧腕屈肌
E. 桡侧腕屈肌

正确答案：D。尺侧腕屈肌

解析：肱桡肌（A错）屈肘关节。掌长肌（B错）屈腕，紧张掌腿膜。拇长屈肌（C错）屈拇指指骨间关节和掌指关节。尺侧腕屈肌（D对）既能屈腕又能收腕，还能屈肘。桡侧腕屈肌（E错）屈和外展腕，屈肘。